具有退虚热功效的药物是
A. 黄连
B. 黄柏
C. 黄芩
D. 栀子
E. 龙胆草

正确答案：B。黄柏

解析：本题考查的是黄柏的功效。具有退虚热功效的药物是黄柏（B对）。黄柏：【功效】清热燥湿，泻火解毒，退虚热。黄连（A错）：【功效】清热燥湿，泻火解毒。黄芩（C错）：【功效】清热燥湿，泻火解毒，止血，安胎。栀子（D错）：【功效】泻火除烦，清热利尿，凉血解毒，消肿止痛。龙胆草（E错）即龙胆。龙胆：【功效】清热燥湿，泻肝胆火。